在下列引起低镁血症的原因中，哪项是不正确的？
A. 严重腹泻
B. 醛固酮分泌减少
C. 高钙血症
D. 甲状旁腺功能低下
E. 糖尿病酮症酸中毒

正确答案：B。醛固酮分泌减少

解析：严重腹泻（A对）时镁在消化道大量丢失致低镁血症。醛固酮有保钠排镁的作用，醛固酮减少（B错，为本题正确答案）可致高镁血症。高钙血症（C对）可抑制肾小管对镁的重吸收。甲状旁腺功能低下（D对）使肾小管对镁的重吸收减少。糖尿病酮症酸中毒时（E对）镁吸收障碍，同时酸中毒能明显妨碍肾小管对镁的重吸收。